下列检查中，对十二指肠溃疡穿孔最具有诊断意义的是
A. 肠鸣音消失
B. 腹腔穿刺
C. 肠鸣音亢进
D. 上腹压痛反跳痛
E. 立位腹部平片可见膈下游离气体

正确答案：E。立位腹部平片可见膈下游离气体

解析：患者，男，28岁餐后突发性右上腹痛，为查明病因，最具有诊断意义的是X线立位腹部平片检查，可见膈下可见半月形的游离气体影（E对）。多数二指肠溃疡穿孔病人既往有溃疡病史，且在数日前溃疡症状加剧。穿孔多在夜间空腹或饱食后突然发生，典型症状是突发性上腹剧痛，呈刀割样，可放射至肩部，很快扩散至全腹。叩诊肝浊音界缩小或消失，可有移动性浊音。听诊肠鸣音消失或明显减弱（AC错）。腹腔穿刺或灌洗，抽出含胆汁或食物残渣的液体时，可作出诊断（B错）。患者全腹压痛，反跳痛（D错），以上腹部最明显，呈“板状腹”。